著名的川产道地药材有
A. 黄连
B. 砂仁
C. 附子
D. 黄柏
E. 三七

正确答案：A、C、D。黄连；附子；黄柏

解析：本题考查的是道地药材。著名的川产道地药材有（A对）、附子（C对）与黄柏（D对）。道地药材（又称地道药材）是指药材质优效佳。目前常用的道地药材包括：1.川药：主产地四川、西藏等。如川贝母、川芎、黄连、川乌、附子、麦冬、丹参、干姜、白芷、天麻、川牛膝、川楝子、川楝皮、川续断、花椒、黄柏、厚朴、金钱草、五倍子、冬虫夏草、麝香等。2.广药：又称“南药”，主产地广东、广西、海南及台湾。如阳春砂（B错）、广藿香、广金钱草、益智仁、广陈皮、广豆根、蛤蚧、肉桂、桂莪术、苏木、巴戟天、高良姜、八角茴香、化橘红、樟脑、桂枝、槟榔等。3.云药：主产地云南。如三七（E错）、木香、重楼、茯苓、萝芙木、诃子、草果、马钱子、儿茶等。4.贵药：主产地贵州。如天冬、天麻、黄精、杜仲、吴茱萸、五倍子、朱砂等。5.怀药：主产地河南。如著名的“四大怀药”——地黄、牛膝、山药、菊花；以及天花粉、瓜蒌、白芷、辛夷、红花、金银花、山茱萸等。6.浙药：主产地浙江。如传统的“浙八味”——浙贝母、白术、延胡索、温郁金、玄参、杭白芍、杭菊花、杭麦冬；以及山茱萸、莪术、杭白芷、栀子、乌梅、乌梢蛇等。7.关药：主产地山海关以北、东北三省及内蒙古东部。如人参、鹿茸、细辛、辽五味子、防风、关黄柏、龙胆、平贝母、刺五加、升麻、桔梗、哈蟆油、甘草、麻黄、黄芪、赤芍、苍术等。8.北药：主产地河北、山东、山西以及内蒙古中部。如党参、酸枣仁、柴胡、白芷、北沙参、板蓝根、大青叶、青黛、黄芩、香附、知母、山楂、金银花、连翘、桃仁、苦杏仁、薏苡仁、小茴香、大枣、香加皮、阿胶、全蝎、土鳖虫、滑石、赭石等。9.华南药：主产地长江以南，南岭以北（湘、鄂、苏、赣、皖、闽等）。如茅苍术、南沙参、太子参、明党参、枳实、枳壳、牡丹皮、木瓜、乌梅、艾叶、薄荷、龟甲、鳖甲、蟾酥、蜈蚣、蕲蛇、石膏、泽泻、莲子、玉竹等。10.西北药：主产地“丝绸之路”的起点西安以西的广大地区（陕、甘、宁、青、新及内蒙古西部）。如大黄、当归、秦艽、秦皮、羌活、枸杞子、银柴胡、党参、紫草、阿魏等。11.藏药：主产地青藏高原地区。著名的藏药如冬虫夏草、雪莲花、炉贝母、红景天，以及甘松、胡黄连、藏木香、藏菖蒲、余甘子、毛诃子、麝香等。